用于抗肠虫的药物是
A. 青蒿素
B. 氯喹
C. 伯氨喹
D. 乙胺嘧啶
E. 阿苯达唑

正确答案：E。阿苯达唑

解析：本题考查阿苯达唑。用于抗肠虫的药物是阿苯达唑（E对）。阿苯达唑是对四咪唑衍生物研究后所得的广谱驱虫药，可阻断虫体对多种营养和葡萄糖的摄取，导致虫体糖原耗竭，致使寄生虫无法生存和繁殖。青蒿素（A错）是含有内酯结构的抗疟药。氯喹（B错）通过插入DNA双螺旋链，干扰了疟原虫裂殖体DNA的复制与转录过程或阻碍了其内吞作用，从而使虫体由于缺乏氨基酸而死亡。伯氨喹（C错）是控制和阻止疟疾传播的首选药。乙胺嘧啶（D错）主要用于疟疾的预防，也可用于治疗弓形虫病。